刺激胰岛B细胞促使胰岛素释放的药物是
A. 甲苯磺丁脲
B. 苯乙双胍
C. 普通胰岛素
D. 精蛋白锌胰岛素
E. 珠蛋白锌胰岛素

正确答案：A。甲苯磺丁脲

解析：本题考查甲苯磺丁脲。甲苯磺丁脲（A对）主要通过刺激胰岛B细胞分泌胰岛素，增加门静脉胰岛素水平，直接抑制肝糖原分解和糖异生作用，使肝生成和输出葡萄糖减少，增加胰外组织对胰岛素的敏感性和糖的利用，降低血糖。苯乙双胍（B错）为双胍类口服降糖药，作用机制为促进外周组织摄取葡萄糖，降低葡萄糖在肠的吸收以及糖原异生，抑制胰高血糖素的释放，从而降低血糖。胰岛素（C错）能促进全身组织细胞对葡萄糖的摄取和利用，并抑制糖原的分解和糖原异生。普通胰岛素、精蛋白锌胰岛素（D错）、珠蛋白锌胰岛素（E错）为作用时间不同的胰岛素制剂，其作用机制均为增加葡萄糖的利用，从而使血糖降低。